颞下颌关节紊乱病关节盘诊断一般使用
A. 许勒位片
B. 关节造影
C. 开口位片
D. 锥形束CT片
E. 下颌横断（牙合）片

正确答案：B。关节造影

解析：本题考查颞下颌关节造影。颞下颌关节紊乱病关节盘诊断一般使用关节造影（B对）。关节盘及其他软组织改变：主要根据关节造影及磁共振检查进行诊断。